在不同药物动力学模型中，计算血药浓度与时间关系涉及不同参数。非房室分析中，平均滞留时间是
A. Km，Vm
B. MRT
C. Kₐ
D. Cl
E. β

正确答案：B。MRT

解析：本题考查药动学中各参数的意义。MRT（B对）为药物在体内的平均滞留时间；Vm是在某条件下，酶被饱和情况下的最高反应速度，Km是使反应浓度达到最高速度一半时底物的浓度（A错）；Kₐ（C错）为吸收速率常数；Cl（D错）为清除率；β（E错）称为消除速度常数或称为慢配置速度常数。